女，30岁。里急后重伴排便不尽感2个月，大便带血近1个月。肛门见可复性肿物，直肠指诊于直肠侧壁触及柔软光滑有蒂包块。对于诊断最有意义的检查是
A. 经阴道B超
B. 结肠镜
C. 结肠X线钡灌肠检查
D. 盆腔CT
E. 经直肠B超

正确答案：B。结肠镜

解析：经直肠指诊发现患者直肠侧壁有有蒂包块，诊断的意义在于明确包块性质，最有意义的检查是结肠镜（B对），可通过直接观察包块情况，必要时取组织活检以确定诊断。超声：包括经阴道B超（A错）和经直肠B超（E错）、结肠X线钡灌肠检查（C错）、盆腔CT（D错）等影像学检查属于间接成像，同时也无相应技术可以明确包块性质，对诊断意义不大。